患者，女，66岁，下颌牙全部缺失，颊系带附着牙槽嵴顶，义齿进食时固位不佳，此时最佳处理方法是
A. 观察，不处理
B. 上颌结节修正术
C. 颊系带矫正术
D. 牙槽突修整术
E. 调磨义齿进行缓冲

正确答案：C。颊系带矫正术

解析：本题考查牙槽外科。唇、颊及舌系带如发生形态、位置及数目异常，影响唇、舌的运动，以致发生哺乳、咀嚼、发音等功能障碍；影响牙齿萌出排列；影响义齿的就位和稳定，常需手术矫正（C对）。